过去曾称作非甲非乙型肝炎病毒的是
A. HAV
B. HBV
C. HCV
D. HDV
E. HEV

正确答案：C。HCV

解析：丙型肝炎病毒（HCV）属于黄病毒科丙型肝炎病毒属，过去曾称作非甲非乙型肝炎病毒。掌握“丙型、丁型、戊型肝炎病毒”知识点。